上下颌双侧后牙缺失，排牙时应以哪个关系位置作标准
A. 第一双尖牙
B. 第二双尖牙
C. 第一磨牙
D. 第二磨牙
E. 第三磨牙

正确答案：C。第一磨牙

解析：本题考查后牙的排列。后牙的排列主要以恢复咀嚼功能为主，因此要求恢复到尖窝交错的最佳状态，而第一磨牙关系的应用很普遍，常被称为（牙合）关键。第一恒磨牙是恒牙中最大、最壮的牙，尖窝较多，其自身稳定的咬合接触利于整个咬合关系的稳定，因此排牙时常以第一磨牙的关系位置作标准（C对）。